氨基苷类抗生素引起的急性毒性反应与何离子的结合有关
A. K⁺
B. Ca²⁺
C. C1⁻
D. Na⁺
E. Mg²⁺

正确答案：B。Ca²⁺

解析：本题考查氨基苷类抗生素的不良反应。氨基苷类抗生素引起的急性毒性反应与Ca²⁺（B对）的结合有关。氨基苷类抗生素与Ca²⁺结合，降低组织内Ca²⁺浓度，降低神经末梢运动终板对乙酰胆碱的敏感性，引起急性毒性反应。